龋第一位好发牙面为
A. 唇颊面
B. 舌腭面
C. 近中面
D. 远中面
E. 咬合面

正确答案：E。咬合面

解析：本题考查龋病的好发牙面。咬面即咬合面，由于其解剖特点有窝沟点隙，最易积存食物和菌斑，不易清洁，所以咬面较其他面最好发龋齿（E对）。近中面（C错）、远中面（D错）即邻面，位置隐密，积存食物时器械不易到达并清洁，为龋病的第二好发部位。颊面（A错）有颊沟不易清洁，为第三龋病好发牙面。舌面有唾液腺分泌的唾液冲刷，腭面沟少，不易积存菌斑和食物残渣，舌腭面（B错）较少患龋。